大汗者大量饮水易出现
A. 低渗性脱水
B. 等渗性脱水
C. 高渗性脱水
D. 等容量性低钠血症
E. 等容量性高钠血症

正确答案：A。低渗性脱水

解析：大量出汗经皮肤丢失大量低渗液，可造成高渗性脱水（C错），若大量饮水而未补充电解质则造成低渗性脱水（A对）。